具有高等学校医学专科学历，参加执业助理医师资格考试，至少应在医疗、预防、保健机构中试用期满
A. 一年
B. 十八个月
C. 三年
D. 六个月
E. 二年

正确答案：A。一年

解析：本题考查参加执业助理医师资格考试的条件。具有高等学校医学专科学历，参加执业助理医师资格考试，至少应在医疗、预防、保健机构中试用期满一年（A对BCDE错）。根据《执业医师法》和相关规定，具有下列条件之一的，可以参加执业助理医师资格考试：①具有高等学校医学专业专科学历或者中等专业学校医学专业学历，在执业医师指导下，在医疗、预防、保健机构中试用期满1年；②以师承方式学习传统医学满3年或者经多年实践医术确有专长的，经县级以上人民政府卫生行政部门确定的传统医学专业组织或者医疗、预防、保健机构考核合格并推荐。